治疗脆弱拟杆菌感染所致吸入性肺脓肿首选的抗菌药物是
A. 红霉素
B. 青霉素
C. 万古霉素
D. 克林霉素
E. 庆大霉素

正确答案：D。克林霉素

解析：治疗脆弱拟杆菌感染所致吸入性肺脓肿首选的抗菌药物是林可霉素、克林霉素（D对）、甲硝唑。红霉素（A错）主要用于治疗支原体、衣原体、军团菌等的感染。青霉素（B错）主要用于治疗除脆弱拟杆菌感染之外的吸入性肺脓肿。MRSA感染应选用万古霉素（C错）。庆大霉素（E错）属于氨基糖苷类抗生素，主要治疗革兰氏阴性菌的感染。